下列不属于骨髓增生异常综合征骨髓常见病态造血表现的是
A. 红系核浆发育不平衡
B. 粒系核分叶过多
C. 粒系细胞颗粒过多
D. 粒系细胞颗粒过少
E. 见到幼稚型巨核细胞

正确答案：C。粒系细胞颗粒过多

解析：骨髓增生异常综合征常见病态造血表现有：①红系：细胞核多核、核多分叶，巨幼样变，细胞质呈空泡状，核浆发育不平衡（A对）；②粒系：细胞核核分叶减少、不规则核分叶增多（B对），细胞胞体小或异常增大，细胞质颗粒减少（D对）或无颗粒（C错，为本题正确答案）；③巨核系：出现小巨核细胞（E对）、核少分叶、多核。